上后牙3/4冠邻沟的位置为
A. 邻面颊1/3
B. 邻面颊1/3与中1/3交界
C. 邻面中1/3
D. 邻面中1/3与舌1/3交界
E. 邻面舌1/3

正确答案：B。邻面颊1/3与中1/3交界

解析：本题考查后牙3/4冠邻沟的位置。上后牙3/4冠邻沟要尽量靠近颊侧的位置，以增加和基牙的接触面积来增加固位，但是为了保证轴沟的厚度、深度、不显露金属，邻面颊1/3与中1/3交界（B对）最为恰当。位于邻面颊1/3（A错）会破坏邻接点，且会显露金属。位于邻面中1/3（C错）、邻面中1/3与舌1/3交界（D错）、邻面舌1/3（E错）不利于3/4冠的固位，也起不到抵抗舌侧固位的作用。